甲氨蝶呤抗肿瘤的主要机制是
A. 抑制二氢叶酸合成酶
B. 抑制二氢叶酸还原酶
C. 破坏DNA结构和功能
D. 嵌入DNA干扰转录RNA
E. 干扰蛋白质合成

正确答案：B。抑制二氢叶酸还原酶

解析：甲氨蝶呤的化学结构与叶酸相似，对二氢叶酸还原酶具有强大而持久的抑制作用（B对）。